不宜做瓷全冠的情况是
A. 前牙邻面缺损大或冠部有多处缺损
B. 前牙氟斑牙、变色牙、四环素染色牙、釉质发育不全影响美观
C. 因发育畸形或发育不良影响美观的前牙
D. 含有活髓的乳牙及青少年恒牙牙体缺损影响美观
E. 错位、扭转牙不宜做正畸治疗

正确答案：D。含有活髓的乳牙及青少年恒牙牙体缺损影响美观

解析：本题考查全瓷冠的适应证。含有活髓的乳牙及青少年恒牙牙体缺损影响美观（D错，为本题的正确答案）不宜做全瓷冠，因为乳牙和年轻恒牙髓角高而且全瓷冠牙体预备量大，做全瓷冠特别容易露髓。前牙邻面缺损大或冠部有多处缺损（A对）时不宜用充填治疗，需做全冠修复。因为这类患牙充填治疗不能使之获得足够的抗力而易发生牙齿的折裂。前牙氟斑牙、变色牙、四环素染色牙、釉质发育不全影响美观（B对）时需做全冠修复，因发育畸形或发育不良影响美观的前牙（C对）也需要做全冠修复，因为这些类型的牙齿只有做全冠修复才能较好的恢复牙齿的外观，从而满足患者对美观的需求。不宜做正畸治疗的错位、扭转牙、发育畸形牙（E对）需要用全冠改善外形和外观。